造成中药品种混乱和复杂的原因主要有
A. 同名异物和同物异名现象普遍存在
B. 一药多基原情况较为普遍
C. 有的药材本草记载不详
D. 药材产地加工方法不当
E. 有的药材在不同的历史时期品种发生了变迁

正确答案：A、B、C、E。同名异物和同物异名现象普遍存在；一药多基原情况较为普遍；有的药材本草记载不详；有的药材在不同的历史时期品种发生了变迁

解析：本题考查的是中药品种对药材质量的影响。造成中药品种混乱和复杂的原因主要有同名异物和同物异名现象普遍存在（A对）、一药多基原情况较为普遍（B对）、有的药材本草记载不详（C对）、有的药材在不同的历史时期品种发生了变迁（E对）。在影响中药质量的因素中，品种是至关重要的因素。中药有效成分多来源于次生代谢产物，不同品种的植物由于遗传特性的不同，合成与积累次生代谢产物的种类及数量可能存在着很大差异。中药的同名异物、同物异名现象普遍存在，严重影响中药材的质量。一药多基原情况普遍存在，有的来源于同属不同种，有的甚至为不同属或不同科。有的药材本草记载不详，有的药材在不同的历史时期品种发生了变迁。